舟车丸的功用是
A. 化瘀行水
B. 行气逐水
C. 攻逐水饮
D. 温阳化饮
E. 健脾利水

正确答案：B。行气逐水

解析：舟车丸治水热内壅，气机阻滞所致之水肿。邪盛势急，形气俱实，当急予攻逐峻剂使水去肿消（B对）。攻逐水饮为十枣汤的功用（C错）。温阳化饮为温脾汤的功用（D错）。其它选项与舟车丸功效不符（AE错）。